患者男，45岁，胸前区疼痛，胸闷，心电图示心肌缺血，患者可能产生牵涉痛的部位是
A. 上腹部或脐区
B. 腹股沟部
C. 右肩
D. 肩颈部
E. 左上臂尺侧

正确答案：E。左上臂尺侧

解析：患者胸前区疼痛，胸闷，心电图示心肌缺血，说明发生了心绞痛，疼痛部位主要位于胸骨后，可放射至心前区和左上臂尺侧（E对）。